男，48岁。呕血5小时入院。查体：P120次/分，BP80/55mmHg。神智不清，营养状况差。巩膜明显黄染，腹壁可见静脉曲张，肝肋下可触及，质地较硬，边缘较钝，脾肋下6cm，移动性浊音阳性，肠鸣音弱。此时不宜采取的处理措施是
A. 快速输血、输液
B. 急诊手术
C. 静脉注射垂体后叶素
D. 内镜下止血治疗
E. 试用三腔管压迫止血

正确答案：B。急诊手术

解析：该患者查体可见巩膜黄染，腹壁静脉曲张，肝肋下可触及，质地较硬，边缘较钝，脾大，移动性浊音阳性提示有腹水，可初步诊断为肝硬化门脉高压症，食管胃底曲张静脉破裂引起呕血是其最常见的并发症。患者已呕血5小时，明显低血压，神志不清，怀疑有出血性休克，应尽快进行快速输血输液（A对）；其止血措施包括：药物止血，尽早给予血管活性药物如静脉注射垂体后叶素（C对）、内镜下止血治疗（D对）、经颈静脉肝内门-体分流术、气囊压迫止血即试用三腔管压迫止血（E对）； 对于没有黄疸、没有明显腹水的病人 （Child A .、 B 级）发生大出血，应争取即时或经短时间准备后即行手术 ，急诊手术（B错，为本题正确答案）并发症多，死亡率较高，该患者有黄疸、腹水不宜行急诊手术 。